阴痒肝肾阴虚型治疗首选
A. 萆薢渗湿汤
B. 五淋散
C. 知柏地黄丸
D. 清肝止淋汤
E. 龙胆泻肝汤

正确答案：C。知柏地黄丸

解析：阴痒肝肾阴虚证，病机为肝肾阴虚，精血两亏，冲任血虚，血燥生风，风动则痒，治宜调补肝肾，滋阴降火，首选方剂为知柏地黄丸（C对）萆薢渗湿汤主治湿热下注之臁疮（A错）。五淋散主要用于膀胱有热，水道不通，尿少次频，脐腹急痛等病症（B错）。清肝止淋汤主治赤带，带下色红，似血非血，淋沥不断（D错）。龙胆泻肝汤可用于治疗肝经湿热下注之阴痒（E错）。